以下关于充分病因的正确真实的陈述是
A. 单个的充分病因不存在，而多个病因可以组合成充分病因
B. 外围的远因不是充分的，但很接近疾病结局的病因是充分的
C. 寻找充分病因有利于彻底预防或根除疾病
D. 充分病因正是概率因果观要抛弃的观念

正确答案：D。充分病因正是概率因果观要抛弃的观念

解析：本题考查充分病因的相关内容。充分病因由一个或多个组分病因构成，是疾病发生所需要的最低条件或组分病因的最小组合，充分病因形成就等于疾病发生。充分病因正是概率因果观要抛弃的观念（D对ABC错）。